在洗手时用做到以下几点，除外的是
A. 洗手之前应先摘除手部饰物，剪短指甲，指甲边缘圆钝
B. 最好采用非手接触式水龙头
C. 任何一次洗手后须擦干
D. 可选择刺激性小的手卫生产品
E. 需要戴手套检查时无需洗手

正确答案：E。需要戴手套检查时无需洗手

解析：注意事项：①洗手之前应先摘除手部饰物，剪短指甲，指甲边缘圆钝。②最好采用非手接触式水龙头；如采用自动感应式、脚踏控制式水管装置。③任何一次洗手后，须擦干。一定要用干净的个人专用毛巾或一次性消毒纸巾擦干，或者使用自动干手机烘干。不能使用用过的毛巾，不能用工作服擦手。若没有条件，可让“湿手”自动晾干。④经常使用肥皂和抗菌剂洗手易引起慢性刺激性接触性皮炎，可选择刺激性小的手卫生产品和洗手后使用润肤产品以减少这类皮炎。使用石油提炼的乳剂可能会破坏乳胶手套的完整性，所以这一类润肤乳应在一天工作结束后使用。掌握“患者、医务人员及环境的防护”知识点。